治疗特发性血小板减少性紫癜出血，应首选
A. 免疫抑制剂
B. 输新鲜血液
C. 脾切除
D. 抗生素
E. 糖皮质激素

正确答案：E。糖皮质激素

解析：治疗特发性血小板减少性紫癜出血应选用糖皮质激素（E对）。糖皮质激素可减少自身抗体生成及减轻抗原抗体反应，抑制单核-巨噬细胞系统对血小板的破坏，改善毛细血管通透性，刺激骨髓造血及血小板向外周血的释放。免疫抑制剂（A错）适用于糖皮质激素或切脾疗效不佳或有禁忌证者；输新鲜血液（B错）属于急症处理；脾切除（C错）适用于糖皮质激素无效者；抗生素（D错）用于抗炎。